患者突然眩晕昏仆，面色苍白，呼吸微弱，汗出肢冷，舌淡，脉沉细微。其证候是
A. 气厥实证
B. 气厥虚证
C. 血厥实证
D. 血厥虚证
E. 痰厥

正确答案：B。气厥虚证

解析：气厥实证是以突然昏倒，不知人事，或四肢厥冷，呼吸气粗，口噤握拳为主症，舌苔薄白，脉伏或沉弦（A错）。题中患者以突然眩晕昏仆为主症，故诊断为厥证，眩晕昏仆，面色苍白，呼吸微弱为中气虚弱甚则下陷，清阳不升，气机不相顺接，血不达上所致，气虚则腠理不固，故汗出，阳气衰微，不能达于四末，故肢冷，舌淡，脉沉细微为正气不足的表现，故辨为气厥虚证（B对）。血厥实证多因急躁恼怒而发，以突然昏倒，不知人事，牙关紧闭，面赤唇紫为主症，舌黯红，脉弦有力（C错）。血厥虚证多因失血过多等原因所致，以突然昏厥，面色苍白，口唇无华，四肢震颤，自汗肢冷，目陷口张，呼吸微弱为主症，舌质淡，脉芤或细数无力（D错）。痰厥常因咳喘宿痰，多湿多痰，恼怒或剧烈咳嗽所致，以突然昏厥，喉有痰声，或呕吐涎沫，呼吸气粗为主症，舌苔白腻，脉沉滑（E错）。